与牙周病发生有关的微生物，证据最充分的是
A. 伴放线放线杆菌、中间普氏菌、核梭杆菌
B. 牙龈卟啉单孢菌、中间普氏菌、牙密螺旋菌
C. 伴放线放线杆菌、牙龈卟啉单孢菌、福赛拟杆菌
D. 中间普氏菌、福赛拟杆菌、牙密螺旋菌
E. 伴放线放线杆菌、福赛拟杆菌、核梭杆菌

正确答案：C。伴放线放线杆菌、牙龈卟啉单孢菌、福赛拟杆菌

解析：本题考查重要的牙周致病菌。伴放线放线杆菌是局限性侵袭性牙周炎的致病菌。牙龈卟啉单孢菌是慢性牙周炎的主要致病菌。福赛拟杆菌是重症牙周炎的致病菌。所以与牙周病发生有关的微生物，证据最充分的是伴放线放线杆菌、牙龈卟啉单孢菌、福赛拟杆菌（C对）。中间普氏菌（AB错）是妊娠期龈炎的主要致病菌，是中等证据的致病菌。核梭杆菌、牙密螺旋菌（DE错）是坏死性溃疡性龈炎的主要致病菌，是中等证据的致病菌。